在破伤风的治疗措施中，下列哪项是关键
A. 彻底清创，引流伤口，消除毒素来源
B. 使用破伤风抗毒素中和游离的毒素
C. 控制和解除痉挛，预防窒息
D. 给予大量青霉素，控制破伤风杆菌
E. 积极支持治疗

正确答案：C。控制和解除痉挛，预防窒息

解析：破伤风最重要的死因为膈肌痉挛导致的窒息，因此控制和解除痉孪，预防窒息（C对）是破伤风治疗的关键措施。彻底清创，引流伤口，消除毒素来源（A错），此为关键的预防措施，在治疗中只能防止毒素进一步入侵，并不能保障患者生命安全。使用破伤风抗毒素中和游离的毒素（B错）能只在早期有效，毒素与神经组织结合后，则难收效。给予大量青霉素，控制破伤风杆菌（D错），可避免疾病的持续和恶化，但无法挽救生命。由于不断阵发性痉挛与抽搐、出大汗等，破伤风患者每日热量消耗和水分丢失较多，因此要积极支持治疗（E错）， 以补充营养和调整水、电解质的平衡，但支持治疗同样需要在痉挛控制、疾病不再恶化的情况下才有意义。